下列哪一项是正常的面部结构的关系
A. 当下颌位于姿势位时，上颌切牙切缘在上唇下缘下约1mm
B. 当下颌位于姿势位时，上颌切牙切缘在上唇下缘下约2mm
C. 当下颌位于姿势位时，上颌切牙切缘在上唇下缘下约3mm
D. 当下颌位于姿势位时，下颌侧切牙切缘在上唇下缘下约1mm
E. 当下颌位于姿势位时，下颌侧切牙切缘在上唇下缘下约2mm

正确答案：A。当下颌位于姿势位时，上颌切牙切缘在上唇下缘下约1mm

解析：本题考查（牙合）分类及临床意义与面部结构。唇齿关系：当下颌位于姿势位时，上颌切牙切缘在上唇下缘下约1mm，下颌前牙与下唇上缘平齐。唇部丰满适度，唇能自然闭合，口角对着上颌尖牙的远中部分或第一前磨牙的近中部分。